某患者经常毁坏黑颜色的物品、电话机、衣服等，谓“黑色要我死亡”此症状属
A. 病理性象征性思维
B. 被害妄想
C. 听幻觉
D. 强制性思维
E. 错觉

正确答案：A。病理性象征性思维